卵巢肿瘤最常见的并发症是
A. 蒂扭转
B. 破裂
C. 囊性变
D. 恶变
E. 感染

正确答案：A。蒂扭转

解析：卵巢肿瘤最常见的并发症是蒂扭转（A对），约10%卵巢肿瘤可发生；其次是破裂（B错），约3%卵巢肿瘤可发生；感染（E错）较少见；恶变（D错）极少见，若肿瘤迅速生长尤其双侧性，应考虑有恶变可能。囊性变（P311）（C错）为子宫肌瘤的常见变性，不属于卵巢肿瘤并发症。